关于蛋白质合成的错误叙述是
A. 20种氨基酸都有相应的密码
B. 氨基酸以氨基与tRNA共价相连
C. 氨基酸与tRNA3'端连接
D. 核糖体是蛋白质翻译的场所
E. mRNA是多肽合成的直接模板

正确答案：B。氨基酸以氨基与tRNA共价相连